临床上将酚妥拉明20mg、多巴胺20mg、呋塞米20mg加入到0.9%氯化钠注射液250ml后，出现黑色沉淀。出现沉淀的原因是
A. 酚妥拉明和多巴胺发生反应
B. 酚妥拉明和呋塞米发生反应
C. 多巴胺和味塞米发生反应
D. 酚妥拉明在葡萄糖溶液中分解
E. 多巴胺在葡萄糖溶液中分解

正确答案：C。多巴胺和味塞米发生反应

解析：本题考查药物的配伍禁忌。多巴胺和味塞米发生反应（C对）出现黑色沉淀。盐酸多巴胺为一种酸性物质，其分子带有两个游离的酚羟基，易被氧化为醌类，最后形成黑色聚合物，在碱性条件下更为明显。呋塞米注射液呈碱性，与盐酸多巴胺配伍后溶液呈碱性，使多巴胺氧化而形成黑色聚合物。为保证用药安全，建议临床应用多巴胺时，不要与呋塞米配伍使用。